下列药物可通过竞争组胺受体而拮抗组胺的作用是
A. 苯海拉明
B. 阿司匹林
C. 普萘洛尔
D. 白三烯拮抗剂
E. 多根皮苷酊磷酸盐

正确答案：A。苯海拉明

解析：生物活性介质拮抗药：苯海拉明或氯苯那敏可通过竞争组胺受体而拮抗组胺的作用。阿司匹林为激肽拮抗剂。多根皮苷酊磷酸盐（白三烯拮抗剂）可拮抗白三烯的作用。掌握“概述及Ⅰ型超敏反应”知识点。